磺胺嘧啶钠注射液与葡萄糖注射液的相互作用属于
A. 物理学变化
B. 化学变化
C. 药效学变化
D. 药动学变化
E. 微生物学变化

正确答案：A。物理学变化